引起病理性血糖升高的原因不包括下列哪种疾病
A. 甲状腺功能亢进症
B. 嗜铬细胞瘤
C. 糖尿病
D. 肾上腺皮质功能亢进症
E. 胰岛细胞瘤

正确答案：E。胰岛细胞瘤

解析：血糖升高包括生理性血糖升高和病理性血糖升高。生理性血糖升高的包括：餐后1～2小时、高糖饮食、剧烈运动等。引起病理性血糖增高的原因包括：各型糖尿病（C对）、甲状腺功能亢进症（A对）、巨人症、肢端肥大症、皮质醇增多症（即肾上腺皮质功能亢进症）（D对）、嗜铬细胞瘤（B对）、颅内高压、心肌梗死等。胰岛细胞瘤（E错，为本题正确答案）分泌过量胰岛素，胰岛素主要作用为降血糖，从而导致血糖病理性减低。